既伸髋关节又屈膝关节
A. 髂腰肌
B. 股薄肌
C. 阔筋膜张肌
D. 股二头肌
E. 股直肌

正确答案：D。股二头肌

解析：髂腰肌（A错）使髋关节前屈和旋外。股薄肌（B错）使髋关节内收和旋外。阔筋膜张肌（C错）紧张阔筋膜，屈髋关节。股二头肌（D对）屈膝、伸髋，使已屈的膝关节旋外。股直肌（E错）属于股四头肌，屈髋关节和伸膝关节